对一口服敌敌畏中毒的患者，治疗错误的是
A. 使用导泻药
B. 立即将患者移出有毒场所
C. 应用胆碱酯酶复活剂
D. 及早、足量反复注射阿托品
E. 用碳酸氢钠洗胃

正确答案：E。用碳酸氢钠洗胃